世界上第一部《医学伦理学》发表在
A. 1913年
B. 1903年
C. 1883年
D. 1813年
E. 1803年

正确答案：E。1803年